天竺黄除清热化痰外，又能
A. 消肿散结
B. 宣散风热
C. 平肝镇惊
D. 清心定惊
E. 开宣肺气

正确答案：D。清心定惊

解析：本题考查天竺黄的功效。天竺黄除清热化痰外，又能清心定惊（D对）。天竺黄【功效】清热化痰，清心定惊。浙贝母【功效】清热化痰，散结消肿（A错）。前胡【功效】降气祛痰，宣散风热（B错）。礞石【功效】消痰下气，平肝镇惊（C错）。桔梗【功效】宣肺（E错），利咽，祛痰，排脓。